长期使用可引起维生素B₁₂缺乏的药物是
A. 二甲双胍
B. 头孢哌酮
C. 华法林
D. 阿司匹林
E. 异烟肼

正确答案：A。二甲双胍

解析：本题考查二甲双胍。长期使用可引起维生素B₁₂缺乏的药物是二甲双胍（A对）。少数患者在使用头孢哌酮（B错）舒巴坦治疗后出现维生素K缺乏。华法林（C错）过量易致各种出血，早期表现有瘀斑、紫癜、牙龈出血、鼻衄、伤口出血经久不愈，月经量过多等。阿司匹林（D错）不良反应较常见的有恶心、呕吐、上腹部不适或疼痛（对胃黏膜的直接刺激引起）等胃肠道反应。异烟肼（E错）为维生素B₆拮抗剂，长期服用可引起维生素B₆缺乏。